关于热原的表述，不正确的是
A. 热原是指微量即能引起恒温动物体温异常升高的物质的总称
B. 大多数细菌都能产生热原，致热能力最强的是革兰阳性杆菌产生的热原
C. 热原是微生物产生的一种内毒素，它存在于细菌的细胞膜和固体膜之间
D. 内毒素是由磷脂、脂多糖和蛋白质所组成的复合物
E. 脂多糖是内毒素的主要成分和致热中心

正确答案：B。大多数细菌都能产生热原，致热能力最强的是革兰阳性杆菌产生的热原

解析：本题考查热原。热原是微生物产生的一种内毒素，它是能引起恒温动物体温异常升高的致热物质（A对）。大多数细菌都能产生热原，其中致热能力最强的是革兰阴性杆菌（B错，为本题正确答案）。热原是微生物的一种内毒素，存在于细菌的细胞膜和固体膜之间（C对），是磷脂、脂多糖和蛋白质的复合物（D对）。其中脂多糖是内毒素的主要成分和致热中心（E对）。